（）提示研究人员对健康者或患者进行生命质量评价时，要关注合适评价标准选择
A. 个体的生理状况
B. 个体的精神状况
C. 生命质量的动态性
D. 个体的社会关系
E. 个体的经济实力

正确答案：C。生命质量的动态性